脾胃气滞最常见的症状是
A. 脘腹胀满
B. 矢气频频
C. 便秘腹痛
D. 食臭嗳气
E. 两胁胀满

正确答案：A。脘腹胀满